强心甙治疗心房纤颤的机制主要是
A. 缩短心房有效不应期
B. 减慢房室传导
C. 抑制窦房结
D. 直接抑制心房纤颤
E. 延长心房不应期

正确答案：B。减慢房室传导

解析：心房纤颤的主要危害是心房过多的冲动下传至心室，引起心室率过快，心输出量减少。强心苷主要是通过兴奋迷走神经或对房室结的直接作用减慢房室传导（B对）、增加房室结中隐匿性传导、减慢心室率、增加心排血量，从而改善循环障碍，但对多数患者并不能终止心房纤颤（D错）。缩短心房有效不应期（A错）、抑制窦房结（C错）、延长心房不应期（E错）都不是强心苷治疗心房纤颤的主要机制。